浅Ⅱ度烧伤创面特征是
A. 局部红肿
B. 局部水泡
C. 红白相间
D. 可见网状栓塞血管
E. 焦黄无水泡

正确答案：B。局部水泡

解析：浅Ⅱ度和深Ⅱ度烧伤均有水疱形成，且前者为大水疱后者为小水疱，而Ⅰ度和Ⅲ度烧伤均无水疱形成，故浅Ⅱ度烧伤创面特征是局部水疱（B对）。由于Ⅰ度烧伤为轻度红肿，浅Ⅱ度烧伤为明显红肿，故局部红肿（A错）不是浅Ⅱ度烧伤的创面特征。创面红白相间（C错）为深Ⅱ度烧伤的特点。创面焦黄无水疱（E错），焦痂下可见网状栓塞血管（D错）为Ⅲ度烧伤的特点。